唐代以前所称的“哕”，是指
A. 呃逆
B. 嗳气
C. 恶心
D. 干呕
E. 噫气

正确答案：A。呃逆

解析：呃逆俗称打呃，唐代以前称‘哕’（A对）。嗳气指胃中气体上出咽喉所发出的一种声长而缓的症状。古称“噫”（B错）。恶心是胃气上逆，泛恶欲吐之证。《罗氏会约医镜》中称：“恶心者，胃口作逆，兀兀欲吐欲呕之状，或又不能呕吐，觉难刻过，此曰恶心”（C错）。前人以有声有物为呕吐，有声无物为干呕（D错）。噫气是嗳气的古称，是胃气上逆的一种表现（E错）。